治疗肘部扭伤，除阿是穴外，宜选用
A. 申脉、丘墟、解溪
B. 膝眼、梁丘、膝阳关
C. 曲池、小海、天井
D. 阳溪、阳池、阳谷
E. 环跳、秩边、承扶

正确答案：C。曲池、小海、天井

解析：曲池是手阳明大肠经腧穴，位于肘区，可用于治疗上肢不遂，肘部扭伤；小海是手太阳小肠经腧穴，位于肘区，具有活血舒筋的功效可治疗肘臂疼痛、肘部扭伤；天井为手少阳三焦经腧穴，也在肘区，具有通络止痛的作用，可用于治疗肘部扭伤；所以除阿是穴外，宜选用曲池、小海、天井（C对）。申脉属足太阳膀胱经，治疗头痛、眩晕、神志疾患、腰腿酸痛等。丘墟属足少阳胆经，治疗目疾、痛症、足内翻、足下垂等；解溪属手阳明胃经，治疗下肢、踝关节疾患、头痛，眩晕、癫狂、腹胀、便秘等（A错）。膝眼为经外奇穴，治疗膝髌肿痛，脚气。梁丘属胃经，治疗急性胃痛、膝肿痛、下肢不遂等下肢病症、乳痈、乳痛等乳疾；膝阳关属胆经，治疗膝腘肿痛、挛急及小腿麻木等下肢、膝关节疾患、脚气（B错）。阳溪属大肠经，治疗头面五官疾病、手腕痛；阳池属三焦经，治疗五官疾病、消渴、口干、腕痛、臂痛；阳谷属小肠经，治疗颈颔肿、臂外侧痛、腕痛等痛证、头面五官病证、热病、癫狂痫（D错）。环跳属胆经，治疗腰胯疼痛，下肢痿痹，半身不遂等腰腿疾患、风疹；秩边属膀胱经，治疗腰骶痛、下肢痿痹等腰及下肢病证、小便不利、 便秘、痔疾；承扶属膀胱经，主治腰、骶、臀、股部疼痛，痔疾，大便难，及坐骨神经痛，下肢麻痹或瘫痪等（E错）。